长期服用可促进食欲和体重增加的抗过敏药是
A. 赛庚啶
B. 异丙嗪
C. 特非那定
D. 氯苯那敏
E. 维生素C

正确答案：A。赛庚啶

解析：本题考查赛庚啶。长期服用可促进食欲和体重增加的抗过敏药是赛庚啶（A对）。赛庚啶为抗过敏药，通过对抗体内组胺对血管、支气管平滑肌的作用，从而消除过敏症状。长期大量应用可加速胃排空，从而增加食欲使得体重增加。异丙嗪（B错）较常见的副作用为嗜睡。特非那定（C错）有可能引起尖端扭转型室速或心电图Q-T间期延长的危险。氯苯那敏（D错）的不良反应有胸闷、咽喉痛、疲劳、虚弱感、心悸或皮肤瘀斑、出血倾向，但都很少见。长期过量服用维生素C（E错），突然停药时有可能出现坏血病症状。